龋病资料整理一般不以哪项分组
A. 年龄
B. 文化程度
C. 性别
D. 城乡
E. 民族

正确答案：B。文化程度

解析：本题考查数据的整理和统计分组。一般不以文化程度（B错，为本题的正确答案）来分组，因为文化程度差异较大，若按文化程度分组，可能会掩饰相关的大量信息。龋病调查结束后常会得到大量的数据资料，在这些资料中有许多数据需要进行统计学分析及整理。数据整理和统计时的分组：常按不同地区及不同人群的特征，如性别（C对）、年龄（A对）、城乡（D对）、种族（E对）等来进行。